可激动γ-氨基丁酸（GABA）受体和阻滞钠通道，属于苯二氮䓬类抗癫痫病药的是
A. 卡马西平
B. 苯妥英钠
C. 加巴喷丁
D. 苯巴比妥
E. 氯硝西泮

正确答案：E。氯硝西泮

解析：本题考查苯二氮䓬类抗癫痫病药。氯硝西泮（E对）属于苯二氮䓬类抗癫痫病药，主要为GABA受体激动剂，可加强突触前抑制，抑制皮质、丘脑和边缘系统的病灶异常放电向周围脑组织的扩散，起抗惊厥作用；卡马西平（A错）属于二苯并氮䓬类抗癫痫药；苯妥英钠（B错）属于乙内酰脲类抗癫痫药，通过减少钠离子内流而使神经细胞膜稳定；加巴喷丁（C错）属于γ-氨基丁酸类似物，增加脑组织GABA的释放；苯巴比妥（D错）属于巴比妥类，增强γ-氨基丁酸A型受体活性发挥抗癫痫作用。